川芎药材的断面特征是
A. 富粉性有排列较稀疏的放射状纹理
B. 外周散有多数黄白色点状维管束断续排列成2～4轮
C. 可见波状环纹及错综纹理散有黄棕色小油点
D. 皮部有4～11个类圆形异型维管束环列形成云锦状花纹
E. 角质样有蜡样光泽内皮层环纹明显维管束呈点状散在

正确答案：C。可见波状环纹及错综纹理散有黄棕色小油点

解析：本题考查的是川芎药材的性状鉴别。川芎药材的断面特征是可见波状环纹及错综纹理散有黄棕色小油点（C对）。川芎：【性状鉴别】药材呈不规则结节状拳形团块。表面黄褐色或褐色，粗糙皱缩，有多数平行隆起的轮节，顶端有凹陷的类圆形茎痕，下侧及轮节上有多数小瘤状根痕。质坚实，不易折断，断面黄白色或灰黄色，可见波状环纹（形成层）及错综纹理，散有黄棕色小油点（油室）。气浓香，味苦、辛，稍有麻舌感、微回甜。富粉性有排列较稀疏的放射状纹理（A错）为防己药材的断面特征。防己：【性状鉴别】药材呈不规则圆柱形、半圆柱形或块状，多弯曲。表面淡灰黄色，在弯曲处常有深陷横沟而成结节状的瘤块样。体重，质坚实，断面平坦，灰白色，富粉性，有排列较稀疏的放射状纹理。气微，味苦。外周散有多数黄白色点状维管束断续排列成2～4轮（B错）为牛膝药材的断面特征。牛膝：【性状鉴别】药材呈细长圆柱形，挺直或稍弯曲。表面灰黄色或淡棕色，有微扭曲的细纵皱纹、排列稀疏的侧根痕和横长皮孔样突起。质硬脆，易折断，受潮后变软，断面平坦，淡棕色，略呈角质样而油润，中心维管束木质部较大，黄白色，其外周散有多数黄白色点状异型维管束，习称“筋脉点”，断续排列成2～4轮。气微，味微甜而稍苦涩。皮部有4～11个类圆形异型维管束环列形成云锦状花纹（D错）为何首乌药材的断面特征。何首乌：【性状鉴别】药材呈团块状或不规则纺锤形。表面红棕色或红褐色，皱缩不平，有浅沟，并有横长皮孔样突起及细根痕。体重，质坚实，不易折断，切断面浅黄棕色或浅红棕色，显粉性，皮部有4～11个类圆形异型维管束环列，形成云锦状花纹，中央木部较大，有的呈木心。气微，味微苦而甘涩。角质样有蜡样光泽内皮层环纹明显维管束呈点状散在（E错）为姜黄药材的断面特征。姜黄：【性状鉴别】药材呈不规则卵圆形、圆柱形或纺锤形，常弯曲，有的具短叉状分枝。表面深黄色，粗糙，有皱缩纹理和明显环节，并有圆形分枝痕及须根痕。质坚实，不易折断，断面棕黄色至金黄色，角质样，有蜡样光泽，内皮层环纹明显，维管束呈点状散在。气香特异，味苦、辛。